1983年ICPEMC规定的遗传学终点是
A. DNA完整性改变与序列改变
B. DNA重排与交换
C. 染色体完整性与分离改变
D. 上述ABC包括了全部遗传学终点

正确答案：D。上述ABC包括了全部遗传学终点

解析：本题考查1983年ICPEMC规定的遗传学终点。1983年ICPEMC规定的遗传学终点是：DNA完整性改变与序列改变；DNA重排与交换；染色体完整性与分离改变（D对ABC错）。